经批准，药品生产企业自定的上市药品名称是
A. 通用名
B. 国际非专有药名
C. 化学名
D. 商品名
E. 习用名

正确答案：D。商品名

解析：本题考查药物的名称。经批准，药品生产企业自定的上市药品名称是商品名（D对）。药品的商品名是由制药企业自己进行选择的，它和商标一样可以进行注册和申请专利保护。药品的通用名（A错）是由国家药典委员会按照《药品通用名称命名原则》组织制定并报国家食品药品监督管理总局备案的药品的法定名称，是同一种成分或相同配方组成的药品在中国境内的通用名称。国际非专有药名（B错）是新药开发者在新药申请时向政府主管部门提出的正式名称，不受专利和行政保护，是任何该产品的生产者都可以使用的名称，也是文献、教材及资料中以及在药品说明书中标明的有效成分的名称。化学名（C错）是根据药品的化学成分确定的化学学术名称。习用名（E错）指药品习惯用名。